男，56岁，发热，咳嗽伴呼吸困难3天，慢性阻塞性肺疾病10年，查体：T38℃，胸部X线示右上肺大片状影，其内可见多个透亮区，痰涂片革兰染色阳性球菌，成簇分布，该患者肺部最可能感染的病原菌是
A. 金黄色葡萄球菌
B. 卡他莫拉菌
C. 溶血性链球菌
D. 厌氧菌
E. 肺炎链球菌

正确答案：A。金黄色葡萄球菌

解析：中年男性患者，发热，咳嗽伴呼吸困难3天，慢性阻塞性肺疾病10年，查体：T38℃（正常值36～37℃），胸部X线示右上肺大片状影，其内可见多个透亮区，痰涂片革兰染色阳性球菌，成簇分布，综合患者的症状、体征和辅助检查，该患者肺部最可能感染的病原菌是金黄色葡萄球菌（A对）。卡他莫拉菌（B错）革兰染色阴性双球菌。溶血性链球菌（C错）呈链状分布。厌氧菌（D错）既有革兰染色阳性菌，也有革兰染色阴性菌。肺炎链球菌（E错）胸部X线早期仅见肺纹理增粗，或受累的肺段、肺叶稍模糊。